男，38岁，口干，多饮，多尿3个月。查体：唇肥厚，下颌前突，咬合困难，手脚粗大肥厚，实验室检查，空腹血糖7.2mmol/L，TG3.0mmol/L，尿比重1.020，最可能的诊断是
A. 糖尿病
B. 尿崩症
C. 甲状腺功能减退症
D. 高甘油三酯血症
E. 肢端肥大症

正确答案：E。肢端肥大症

解析：患者青年男性（肢端肥大症好发人群），口干，多饮，多尿3个月。查体：唇肥厚，下颌前突，咬合困难，手脚粗大肥厚，（肢端肥大症常见症状），实验室检查，空腹血糖7.2mmol/L（正常值3.89～5.6mmol/L），TG3.0mmol/L（正常值0.2～1.2mmol/L），尿比重1.020（正常值1.015～1.025），结合病史及临床症状，该患者初步诊断为肢端肥大症（E对）。糖尿病（A错）无骨骼和皮肤相关生长激素过度分泌表现。尿崩症（B错）有低比重尿和低渗尿，且无生长激素过度分泌表现。甲状腺功能减退症（C错）、高甘油三酯血症（D错）均无生长激素过度分泌表现。